出生45天，女，患儿发热3天，喂养困难，嗜睡，阵发性惊厥，咳嗽，平静时有喘鸣音，体温39.0℃，其治疗原则应为
A. 降温、加强营养
B. 对症处理、抗病毒、抗生素治疗
C. 止咳、降温、加强营养
D. 保证母乳喂养、加强护理
E. 降温、母乳喂养

正确答案：B。对症处理、抗病毒、抗生素治疗